起于蝶骨角棘，在迅速大张口时，具有悬吊下颌、防止张口过大的作用的是
A. 颞下颌韧带
B. 翼下颌韧带
C. 蝶下颌韧带
D. 茎突下颌韧带
E. 茎突舌骨韧带

正确答案：C。蝶下颌韧带

解析：蝶下颌韧带：又称为内侧韧带，起于蝶骨角棘，止于下颌升支的下颌小舌和下颌孔下缘。在迅速大张口时，具有悬吊下颌、防止张口过大的作用。掌握“颞下颌关节的解剖特点”知识点。